过量服用对乙酰氨基酚会出现毒性反应，应及早使用的解毒药是
A. N-乙酰半胱氨酸
B. 半胱氨酸
C. 谷氨酸
D. 谷胱甘肽
E. N-乙酰甘氨酸

正确答案：A。N-乙酰半胱氨酸

解析：本题考查对乙酰氨基酚。长期服用对乙酰氨基酚会出现毒性反应，应及早使用的解毒药是N-乙酰半胱氨酸（A对）。对乙酰氨基酚主要在肝脏代谢，大部分与葡萄糖醛酸及硫酸结合，从尿中排泄。少量生成有毒的N-羟基乙酰氨基酚，进一步转化成毒性代谢物N-乙酰亚胺醌。在正常情况下，N-乙酰基亚胺醌可与肝内的谷胱甘肽结合而解毒。若应用本品过量时，因谷胱甘肽被耗尽，代谢物即与肝蛋白结合，引起肝组织坏死。各种含巯基的药物可用作对乙酰氨基酚过量的解毒剂。尽早使用巯基供体N-乙酰半胱氨酸（A对）可增加肝细胞内谷胱甘肽的储存，阻止乙酰亚胺醌与肝脏蛋白的共价结合。半胱氨酸（B错）也含有巯基，不过多选用N-乙酰半胱氨酸作为解毒药。谷胱甘肽（D错）可用于螯合重金属、氟化物、芥子气等毒素中毒。谷氨酸（C错）和N-乙酰甘氨酸（E错）中不含有游离的巯基，不能用于对乙酰氨基酚的过量解毒。